流行性乙型脑炎的防御措施是
A. 灭虱
B. 灭鼠
C. 灭蜱
D. 灭蚤
E. 灭蚊

正确答案：E。灭蚊

解析：流行性乙型脑炎的防御措施是灭蚊（E对），防蚊和灭蚊是预防乙脑病毒传播的重要措施。灭虱（A错）是流行性斑疹伤寒的防御措施（P138）。灭鼠（B错）是流行性出血热的防御措施（P85）。灭蚤（D错）灭鼠是地方性斑疹伤寒的防御措施（P140）。灭蜱（D错）是人无形体病的防御措施（P145）。